男性，40岁。右侧下颌骨磨牙区及下颌角处出现无痛性、逐渐膨大的肿块7年，生长缓慢。扪之有乒乓球感，无明显触痛。口内检查见右侧磨牙发生移位。X线片示：多房性囊性阴影，边缘不整齐呈半月形切迹状，无明显钙化灶影像。拟诊为
A. 牙源性钙化上皮瘤
B. 牙源性钙化囊肿
C. 牙源性角化囊肿
D. 成釉细胞瘤
E. 化牙骨质纤维瘤

正确答案：D。成釉细胞瘤

解析：本题考查成釉细胞瘤。成釉细胞瘤的X线表现为多房性囊性阴影，边缘不整齐呈半月形切迹状，在囊内牙根尖有不同程度的吸收现象（D对）。牙源性角化囊肿在X线上显示为一清晰圆形的透明阴影，边缘整齐，周围常呈现一明显白色骨质反应线，有时边缘可不整齐（C错）。如X线表现类似成釉细胞瘤并伴有钙化灶时，还应考虑为其他牙源性肿瘤，如化牙骨质纤维瘤（E错）、牙源性钙化上皮瘤（A错）、牙源性钙化囊肿（B错）等，但最后诊断仍需依靠病理检查。